下列药物中，服用后不影响驾驶行为的是
A. 东茛菪碱片
B. 阿米洛利片
C. 左甲状腺素钠片
D. 氟桂利嗪胶囊
E. 唑吡坦片

正确答案：C。左甲状腺素钠片

解析：本题考查左甲状腺素钠片。服用后不影响驾驶行为的是左甲状腺素钠片（C对）。左甲状腺素钠片如果剂量过度，会发生心绞痛、腹泻、震颤、兴奋、头痛、不安、失眠、多汗、体重减轻、骨骼肌痉挛等，通常在减少用量或停药数日后，上述表现消失，左甲状腺素钠片不影响驾驶员驾驶行为。东莨菪碱（A错）可使驾驶员视物模糊或辨色困难，影响驾驶员驾驶行为。阿米洛利片（B错）可导致驾驶员多尿或多汗，影响驾驶员驾驶行为。周围血管扩张药氟桂利嗪（D错）常使人有抑郁感、嗜睡、四肢无力、倦怠或眩晕，影响驾驶员驾驶行为。唑吡坦（E错）可引起共济失调、精神错乱、认知障碍等，影响驾驶员驾驶行为。